属于精神分析疗法的是
A. 系统脱敏
B. 厌恶疗法
C. 自由联想
D. 森田疗法
E. 催眠疗法

正确答案：C。自由联想